50096-1999）》规定居室净高为
A. 1.8m～2.2m
B. 2.0m～2.5m
C. 2.4m～2.8m
D. 2.5m～3.0m
E. 3.0m～3.5m

正确答案：C。2.4m～2.8m

解析：本题考查我国《住宅建筑设计规范（GB 50096-1999）》规定居室净高高度。我国《住宅建筑设计规范（GB 50096-1999）》规定居室净高为2.4m～2.8m（C对ABDE错）。